男性，25岁。间断左耳流脓5个月，两个月来左外耳道干燥。近一个月来出现持续性头痛，体温38℃左右。入院前两周头痛加重，伴呕吐。三小时前呼之不应，急诊入院。入院查体，中度昏迷，瞳孔左：右＝4：2，对光反应消失，右侧肢体力弱，以上肢为著，右侧霍夫曼氏征（+）。应尽快采取的检查项目是
A. 腰椎穿刺术
B. 血培养
C. 脑电图
D. 头颅X线平片
E. 头颅CT

正确答案：E。头颅CT

解析：患者初步诊断已有致脑疝形成。脑疝是颅内压增高的严重后果。因此应尽快行头颅CT（E对）检查，明确病损部位及严重程度。腰椎穿刺术是脑疝的禁忌症，腰穿会使脑脊液压力突然降低，此时脑疝突出的程度加重，脑干等部位受压加重，甚至可以导致死亡。血培养（B错）和脑电图（C错）对脑疝的诊断意义不大。头颅X线平片（D错）只能显示颅骨的相关病变，不能显示脑组织的占位性病变。